关于正中神经的描述，正确的是
A. 起自臂丛后束
B. 在臂部与肱动脉伴行，并支配肱二头肌
C. 在前臂行于指浅、指深屈肌之间
D. 越过腕横韧带(屈肌支持带)表面进入手掌部
E. 支配鱼际肌及第1、2蚓状肌

正确答案：C。在前臂行于指浅、指深屈肌之间

解析：正中神经由臂丛内侧束和外侧束的内侧根和外侧根汇合而成（A错），下行途中，逐渐从外侧跨过肱动脉至其内侧，伴随同名血管一起降至肘窝。从肘窝继续向下穿旋前圆肌和指浅屈肌腱弓后在前臂正中下行，于指浅、深屈肌之间到达腕部（C对），然后行于桡侧腕屈肌健与掌长肌键之间，并进入屈肌支持带深面的腕管，最后在掌腿膜深面分布至手掌（D错）。肌皮神经支配肱二头肌（B错）。其运动纤维支配第1、2蚓状肌和鱼际肌（拇收肌除外）（E错）。